男性，16岁。能量供给量为2900kcal，蛋白质提供的热能占总热能的12%。该学生烟酸的供给量应是
A. 6mg
B. 10mg
C. 12mg
D. 15mg
E. 18mg

正确答案：D。15mg